霍乱发病主要由哪项引起
A. 肠毒素
B. 细胞毒素
C. 神经毒素
D. 内毒素
E. 类毒素

正确答案：A。肠毒素

解析：霍乱，指主要由霍乱肠毒素（A对）引起的分泌性腹泻，临床表现轻重程度不一，一般以轻症多见。霍乱弧菌产生三种毒素：I型毒素为内毒素（D错），是制作菌苗引起疫苗免疫的主要成分；Ⅱ型毒素为外毒素，即霍乱肠毒素，是霍乱弧菌在体内繁殖时产生的代谢产物，霍乱肠毒素是引起霍乱的主要致病物质，可引起剧烈腹泻，该毒素还具有抗原性，可刺激机体产生中和抗体；Ⅲ型毒素在发病作用上意义不大。细胞毒素（B错）是蛇毒中重要的一种活性蛋白，是眼镜蛇毒的主要毒性成分之一，常见于蛇咬伤，可用于抗肿瘤治疗，不是引起霍乱发病的原因。神经毒素（C错），多为天然存在，为对神经组织有毒性或破坏性的内毒素，可视周围神经有髓鞘、脑和脊髓及其他组织产生脂肪性变，不是引起霍乱发病的原因。类毒素（E错）为某些细菌外毒素经甲醛等处理后脱毒的制品，毒性虽消失，但免疫原形不变，故仍然具有刺激人体产生抗毒素，以起到机体从此对某疾病具有自动棉衣的作用，它们广泛地应用于预防某些传染病，不是引起霍乱发病的原因。